检查凝血功能的化验是
A. 出血时间
B. 纤维蛋白原定量
C. 血块收缩试验
D. 3P试验
E. 血小板计数

正确答案：B。纤维蛋白原定量

解析：纤维蛋白原定量（B对）是检查凝血功能的化验。出血时间（A错）的长短反映血小板的数量、功能以及血管壁的通透性、脆性的变化；也反映血小板生成的血栓烷a2与血管壁生成的前列环素的平衡关系；某些血液因子缺乏也会导致出血时间延长。血块收缩试验（C错）可反映血小板血块收缩能力。3P试验（血浆鱼精蛋白副凝固试验）（D错）是鉴别原发性纤溶症和继发性纤溶症（DIC）的试验之一。血小板计数（E错）可反映血小板的生成、分布和消耗的情况。